治疗湿浊蒙蔽，神志昏乱证，应选用的药物是
A. 天南星
B. 石菖蒲
C. 竹沥
D. 冰片
E. 牛黄

正确答案：B。石菖蒲

解析：石菖蒲辛开苦燥温通，芳香走窜，善于化湿、豁痰、辟秽而开窍醒神；擅治痰湿秽浊之邪蒙蔽清窍所致之神志昏乱（B对）。天南星的功效为燥湿化痰，祛风止痉，散结消肿。治疗顽痰咳喘，胸膈胀闷；风痰眩晕，中风痰壅，口眼㖞斜，半身不遂，癫痫，惊风，破伤风；痈肿，瘰疬痰核，蛇虫咬伤（A错）。竹沥的功效为清热豁痰，定惊利窍。治疗痰热咳喘；中风痰迷，惊痫癫狂（C错）。冰片的功效为开窍醒神，清热止痛。治疗热病神昏，惊厥，中风痰厥，气郁暴厥，中恶昏迷；胸痹心痛；目赤肿痛，口舌生疮，咽喉肿痛，耳道流脓；疮疡肿痛，久溃不敛，烧烫伤（D错）。牛黄的功效为凉肝息风，清心豁痰，开窍醒神，清热解毒。治疗温热病及小儿急惊风，惊厥抽搐，癫痫发狂；热病神昏，中风痰迷；咽喉肿痛，口舌生疮，痈肿疔疮（E错）。